牙髓钙化与三叉神经痛鉴别要点是
A. 疼痛的部位
B. 有无扳机点
C. 疼痛的性质
D. 发病的原因
E. 病程的长短

正确答案：B。有无扳机点

解析：因髓石压迫牙髓神经引起的放射性痛应与三叉神经痛鉴别，无扳机点是鉴别要点。掌握“牙髓坏死、牙髓钙化与牙内吸收”知识点。